乳剂中重力作用可造成哪种不稳定现象
A. 分层
B. 转相
C. 酸败
D. 絮凝
E. 破裂

正确答案：A。分层

解析：本题考查乳剂。乳剂属于热力学不稳定的非均相分散体系。乳剂常发生下列变化：1.分层。乳剂的分层系指乳剂放置后出现分散相粒子上浮或下沉的现象，又称乳析。分层（A对）主要是由于分散相和分散介质之间的密度差造成的。2.絮凝。乳剂中分散相的乳滴发生可逆的聚集现象称为絮凝。发生絮凝（D错）的条件是乳滴的电荷减少，使ζ电位降低，乳滴产生聚集而絮凝。3.转相。由于某些条件的变化而改变乳剂的类型称为转相，由O/W型转变为W/O型或由W/O型转变为O/W型。转相（B错）主要是由于乳化剂的性质改变而引起的。4.合并与破裂（E错）。乳化膜破裂导致乳滴变大称为合并。合并进一步发展使乳剂分为油、水两相称为破裂。5.酸败（C错）。乳剂受外界因素及微生物的影响，使油相或乳化剂等发生变化而引起变质的现象称为酸败。